唇部皮肤来源者应划入哪种癌症的范围中
A. 唇癌
B. 颊黏膜癌
C. 皮肤癌
D. 口底癌
E. 中央性颌骨癌

正确答案：C。皮肤癌

解析：唇部皮肤来源者应划入皮肤癌中。掌握“颊癌、口底癌及唇癌”知识点。